某男，50岁，患胸痹日久，痛如针刺而有定处，内热烦闷、心悸失眠、急躁易怒。证属气滞血瘀，宜选用的成药是
A. 丹七片
B. 逐瘀通脉胶囊
C. 血府逐瘀口服液
D. 血塞通颗粒
E. 通心络胶囊

正确答案：C。血府逐瘀口服液

解析：本题考查的是血府逐瘀口服液的主治。患胸痹日久，痛如针刺而有定处，内热烦闷、心悸失眠、急躁易怒。证属气滞血瘀，宜选用的成药是血府逐瘀口服液（C对）。血府逐瘀口服液：【主治】气滞血瘀所致的胸痹、头痛日久、痛如针刺而有定处、内热烦闷、心悸失眠、急躁易怒。丹七片（A错）：【主治】瘀血痹阻所致的胸痹心痛、眩晕头痛、经期腹痛。逐瘀通脉胶囊（B错）：【主治】血瘀所致的眩晕，症见头晕、头痛、耳鸣、舌质黯红、脉沉涩；高血压、脑梗死、脑动脉硬化等病见上述证候者。血塞通颗粒（D错）：【主治】瘀血阻络所致的中风偏瘫、肢体活动不利、口眼㖞斜、胸痹心痛、胸闷气憋；中风后遗症及冠心病心绞痛属上述证候者。通心络胶囊（E错）：【主治】心气虚乏、血瘀络阻证所致的冠心病心绞痛，症见胸部憋闷、刺痛、绞痛、固定不移、心悸自汗、气短乏力、舌质紫黯或有瘀斑、脉细涩或结代。亦用于气虚血瘀络阻型中风病，症见半身不遂或偏身麻木、口舌㖞斜、言语不利。